根据药品不良反应报告和监测管理办法，进口药品自首次获准进口之日起5年内，应报告该药品发生的
A. 新的不良反应
B. 严重的不良反应
C. 所有的不良反应
D. 一过性的不良反应
E. 境外发生的不良反应

正确答案：C。所有的不良反应

解析：本题考查药品不良反应报告与处置。根据药品不良反应报告和监测管理办法进口药品自首次获准进口之日起5年内，应报告该药品发生的（C对）。《药品不良反应报告和监测管理办法》第三章报告与处置第二节个例药品不良反应第二十条：新药监测期内的国产药品应当报告该药品的所有不良反应；其他国产药品，报告新的和严重的不良反应（AB错）。进口药品自首次获准进口之日起5年内，报告该进口药品的所有不良反应；满5年的，报告新的和严重的不良反应。